物理量的单位符号为：运动黏度
A. kPa
B. Pa·S
C. mm²/s
D. cm⁻¹
E. ㎛

正确答案：C。mm²/s